推断某因素与某病有因果关系，此因素应与该病关联且有一定强度，在不同研究中此关联不断出现，可疑的病因出现在前，且在医学和生物学上言之成理，还需要
A. 关联必须特异，即某因素仅与某病有联系
B. 因素与疾病必须是真联系不是假关联或间接关联
C. 排除选择偏性或信息偏性
D. 疾病的诊断必须正确
E. 因素与疾病的分布相符，并有剂量反应关系

正确答案：E。因素与疾病的分布相符，并有剂量反应关系

解析：本题考查病因推断。推断某因素与某病有因果关系，可疑的病因出现在前，且在医学和生物学上言之成理，还需要因素与疾病的分布相符，并有剂量反应关系（E对ABCD错）。必须符合希尔病因推断中的关联强度以及剂量反应关系。